CD8⁺T细胞活化的协同刺激信号是
A. IL-1受体的表达
B. IL-2的作用
C. IL-5的作用
D. TCR识别Ag肽-MHCⅡ类分子复合物
E. CD8⁺T细胞与APC间黏附分子及协同刺激分子的作用

正确答案：E。CD8⁺T细胞与APC间黏附分子及协同刺激分子的作用